麦角胺生物碱与咖啡因同时口服
A. 产生协同作用，增强药效
B. 减少或延缓耐药性的发生
C. 形成可溶性复合物，有利于吸收
D. 改变尿液pH，有利于药物代谢
E. 利用药物间的拮抗作用，克服某些药物的毒副作用

正确答案：C。形成可溶性复合物，有利于吸收